若该患者临床2型糖尿病已证实，其首选治疗方案是
A. 饮食管理
B. 体育锻炼
C. 减肥药物
D. 口服磺脲类降糖药
E. 胰岛素

正确答案：A。饮食管理